与噬菌体的吸附功能有关的是
A. 尾部特殊受体
B. 头部衣壳遗传物质
C. 尾部遗传物质
D. 头部衣壳特殊受体
E. 头部衣壳内DNA

正确答案：A。尾部特殊受体

解析：噬菌体的化学组成：大多数噬菌体呈蝌蚪形，其头部衣壳和尾部的化学组成是蛋白质且具有抗原性，头部衣壳内含有噬菌体的遗传物质即DNA或RNA，尾部有能识别宿主菌细胞表面的特殊受体，与噬菌体的吸附功能有关。掌握“噬菌体性状及分类”知识点。